以下不属于常用的反映儿童少年心肺功能指标的是
A. 心率
B. 胸部X线片
C. 脉搏
D. 心电图
E. 肺活量

正确答案：B。胸部X线片